垂体窝位于下列哪个结构的上面
A. 筛窦
B. 额窦
C. 蝶窦
D. 上颌窦
E. 无

正确答案：C。蝶窦

解析：垂体窝位于蝶窦上方（C对）。